义齿修复前常需进行牙槽骨修整的部位，不包括
A. 下颌双尖牙舌侧
B. 上颌结节
C. 磨牙后垫
D. 上颌硬腭正中区
E. 拔牙创部位

正确答案：C。磨牙后垫

解析：本题考查修复前外科处理。义齿修复前常需进行牙槽骨修整的部位，不包括磨牙后垫（C错，为本题的正确答案）。磨牙后垫位于下颌最后磨牙牙槽嵴远端的黏膜软衬，由疏松的结缔组织构成，稳定，很少吸收，可作为指导全口义齿排列人工牙的标志，不属于义齿修复前常需进行牙槽骨修整的部分。骨隆突系正常骨骼上的骨性隆起，过大的骨隆突在义齿摘戴时可引起组织破溃疼痛，严重者义齿无法戴入使用，义齿修复前应及时进行修整术。下颌双尖牙舌侧（A对）存在下颌隆突、上颌硬腭正中区（D对）存在腭隆突、上颌结节（B对）孤独增生形成的骨质倒凹等，妨碍义齿就位，故义齿修复前常需进行修整。拔牙时由于创伤过大造成牙槽嵴变形或骨质吸收不均者拔牙创部位（E对）常形成骨尖或骨突，若一段时间不消退，且有疼痛，或有明显倒凹妨碍义齿摘戴时，应进行牙槽骨修整术去除过突的骨尖或骨突。